大豆中能影响锌、钙、镁、铁被吸收利用的物质是
A. 水苏糖
B. 棉籽糖
C. 植酸
D. 硫代葡萄糖苷
E. 皂苷

正确答案：C。植酸